可用于慢性消耗性疾病的蛋白同化激素是
A. 戊酸雌二醇
B. 他莫昔芬片
C. 地屈孕酮
D. 依普黄酮
E. 司坦唑醇

正确答案：E。司坦唑醇

解析：本题考查蛋白同化激素。司坦唑醇（E对）临床适用于防治遗传性血管神经性水肿、慢性消耗性疾病、重病及术后体弱消瘦、年老体弱、再生障碍性贫血、高脂血症等。戊酸雌二醇（A错）口服用于缓解绝经后更年期症状、卵巢切除后及非癌症疾病放疗性去势的雌激素缺乏引起的症状。与孕激素类药物合用，可作避孕药。地屈孕酮（C错）用于习惯性流产。天然孕激素黄体酮（孕酮）及其衍生物主要用于不孕症、先兆流产及习惯性流产等。